最易发生抗原变异的流感病毒是
A. 甲型流感病毒
B. 乙型流感病毒
C. 丙型流感病毒
D. 甲1型流感病毒
E. 新甲1型流感病毒

正确答案：A。甲型流感病毒

解析：本题考查最易发生抗原变异的流感病毒。流感病毒是引起流行性感冒的病原体，包括甲型流感病毒、乙型流感病毒和丙型流感病毒，其中最容易发生抗原变异的是甲型流感病毒（A对BCDE错）。